急性胆囊炎，可见
A. Murphy（莫菲征）阳性
B. 麦氏点压痛
C. Courvoisier（库瓦济埃征）阳性
D. Courvoisier（库瓦济埃征）阴性
E. 板状腹

正确答案：A。Murphy（莫菲征）阳性

解析：急性胆囊炎可见体征有右上腹的压痛、反跳痛及肌紧张，Murphy（莫菲征）阳性（A对）。麦氏点压痛（B错）提示可能为阑尾炎。在胰头癌压迫胆总管导致阻塞时，发生明显黄疸，且逐渐加深，胆囊显著肿大，但无压痛，称为Courvoisier征，Courvoisier（库瓦济埃征）阳性（C错）提示胰头癌引起梗阻性黄疸。在胆总管结石梗阻所致的黄疸病人中，由于胆囊也常有慢性炎症，囊壁因纤维而皱缩，且与周围组织粘连而失去移动性，因而有黄疸但胆囊常不肿大，称为Courvoisier（库瓦济埃征）阴性（D错）。板状腹（E错）提示腹膜炎。